关于下颌支的内面的结构的叙述，不正确的是
A. 下颌孔的前方为下颌小舌，为蝶下颌韧带的附着处
B. 下颌孔的后上方有下颌神经沟
C. 下颌孔的前上方有下颌隆突
D. 下颌孔的下方有下颌舌骨沟
E. 下颌小舌的后下方骨面粗糙称为咬肌粗隆

正确答案：E。下颌小舌的后下方骨面粗糙称为咬肌粗隆

解析：下颌支内侧面中央略偏后上方有下颌孔；孔的前方有下颌小舌，为蝶下颌韧带附着处；孔的后上方有下颌神经沟，下牙槽神经、血管通过此沟进入下颌孔；下颌孔向前下方通入下颌管。下颌支后缘与下颌体下缘相连接处称下颌角，下颌角的内面有翼肌粗隆，外面有咬肌粗隆，为相应咀嚼肌附着处。掌握“下颌骨及腭骨解剖特点”知识点。